医药经营企业，应严格实行双人双锁保管的是
A. 毒性药品
B. 解热镇痛药
C. 易挥发性药品
D. 生物制品
E. 麻醉药品

正确答案：A、E。毒性药品；麻醉药品

解析：本题考查实行双人双锁。医药经营企业，应严格实行双人双锁保管的是毒性药品（A对）、麻醉药品（E对）。储存毒性药品的专库或专柜，其条件要求与储存麻醉药品的专库条件相同，毒性药品可与麻醉药品存放在同一专用库房或专柜中。专库或专柜加锁并由专人保管，做到双人双锁管理，专账记录。麻醉药品和第一类精神药品入出库实行双人核查制度，药品入库须双人验收，出库须双人复核，做到账、物相符。